Auer小体不见于
A. M1型白血病
B. M2型白血病
C. M3型白血病
D. 急性淋巴细胞白血病
E. 急性单核细胞白血病

正确答案：D。急性淋巴细胞白血病

解析：Auer小体（棒状小体）是白细胞胞质中出现红色细杆状物质，一个或数个，长约1～6μm。棒状小体一旦出现在细胞中，就可拟诊为白血病。急性淋巴细胞白血病（D对）无此种小体。M₁（急性粒细胞白血病未分化型）（A错）、M₂（急性粒细胞白血病部分分化型）（B错）、M₃（急性早幼粒细胞白血病）（C错）和急性单核细胞白血病（E错）时可见到此小体。